下列关于维生素A叙述正确的是
A. 1日量大于600mg可引起恶心、呕吐、胃痉挛
B. 头痛、眼花、烦躁、心律失常、浮肿和神经衰弱
C. 全身不适、发热、颅内压增高、毛发干枯、皮肤瘙痒、食欲缺乏
D. 低热、烦躁、惊厥、厌食、体重下降、肝脏肿大、肾脏损害、骨骼硬化等
E. 400～800mg/d可引起视力模糊、乳腺肿大、腹泻、头晕、流感样综合症

正确答案：C。全身不适、发热、颅内压增高、毛发干枯、皮肤瘙痒、食欲缺乏

解析：本题考查维生素A。长期大量服用维生素A可引起慢性中毒，出现疲乏、软弱、全身不适、发热、颅内压增高、夜尿增多、毛发干枯或脱落、皮肤干燥或瘙痒（C对）、体重减轻、四肢疼痛、贫血、眼球突出、剧烈疼痛等现象。维生素D能促进小肠对钙的吸收，提高血钙、血磷浓度。临床用于预防和治疗维生素D缺乏引起的佝偻病，长期使用引起低热、烦躁哭闹、惊厥、厌食、体重下降、肝脏肿大、肾脏损害、骨硬化等（D错）。维生素C可用于防治坏血病，大量应用（每日用量1g以上）可引起腹泻；每日用量600mg以上时引起恶心、呕吐、胃痉挛（A错）。维生素B₁长期大量使用可出现头痛、眼花、烦躁、心律失常、浮肿和神经衰弱等严重神经感觉异常（B错）。维生素E能促进生殖力，大量服用维生素E（400～800mg/d）可引起视物模糊、乳腺肿大、类流感样综合征、胃痉挛、疲乏、软弱（E错）。